下列哪项不属于疫源地消灭的条件之一
A. 病人已经离开疫源地
B. 对病家进行了终末消毒
C. 对疫源地进行了终末消毒
D. 对疫源地连续观察了一个最长潜伏期未发现新病人
E. 对疫源地连续观察了一个最长传染期未发现新病人

正确答案：E。对疫源地连续观察了一个最长传染期未发现新病人

解析：本题考查疫源地消灭的条件。疫源地的消灭必须具备下列条件：①传染源被移走（A对）或不再排出病原体；②通过各种措施消灭了传染源排到外环境的病原体，如对病家（B对）和疫源地（C对）进行终末消毒；③传染源周围的所有易感接触者经过该病最长潜伏期没有出现新病例或新感染者（D对）。对疫源地连续观察了一个最长传染期未发现新病人（E错，为本题正确答案）不能证明疫源地已经被消灭。